使用非甾体抗炎药的注意事项有
A. 避免两种或两种以上药物同时服用
B. 坚持阶梯式增量和阶梯式渐次减量
C. 为减少胃肠道反应宜餐中服用
D. 有心肌梗死病史者选用昔布类
E. 肝肾功能不全者慎用

正确答案：A、B、C、E。避免两种或两种以上药物同时服用；坚持阶梯式增量和阶梯式渐次减量；为减少胃肠道反应宜餐中服用；肝肾功能不全者慎用

解析：本题考查非甾体抗炎药的禁忌症及用药注意事项。使用非甾体抗炎药的注意事项有：避免两种或两种以上药物同时服用（A对），因其疗效不叠加，不良反应增多；坚持阶梯式增量和阶梯式渐次减量（B对）能够降低用药风险；为减少胃肠道反应宜餐中服用（C对）；肝肾功能不全者慎用（E对）；有心肌梗死病史者选用昔布类会增加心血管疾病复发及死亡风险，不能选用（D错）。